选择无尖牙作为人工后牙的主要优点是
A. 减少侧向力，有助于义齿稳定
B. 降低咀嚼效能，有助于减轻牙槽嵴负担
C. 容易确定颌位关系医学
D. 人工牙无需达到平衡牙合
E. 以上都不是

正确答案：A。减少侧向力，有助于义齿稳定

解析：本题考查非解剖式牙的优点。无尖牙是非解剖式牙的一种，牙尖0°，无尖牙无高出（牙合）面的牙尖，（牙合）面仅有窝沟、排溢沟，上下后牙（牙合）面间是平面接触，可以减少侧向力，有助于义齿稳定（A对），因此咀嚼效能低，有助于减轻牙槽嵴负担（B错），这是缺点。上下后牙（牙合）面间是平面接触，所以颌关系不稳定，不利于确定颌位关系（C错）。任何颌型的全口义齿均需要平衡（牙合），以使义齿在功能时保持固位和稳定，以保证恢复功能和组织保健（D错），这不是无尖牙的特点。